在实验室中常用的细菌接种环，试管口等进行灭菌的方法是
A. 焚烧法
B. 烧灼法
C. 巴氏消毒法
D. 煮沸法
E. 高压蒸汽灭菌法

正确答案：B。烧灼法

解析：烧灼法：为直接用火焰灭菌，例如在微生物学实验室内，利用火焰对接种环、试管口等灭菌。掌握“消毒与灭菌”知识点。